胃癌最常发生的转移途径为
A. 直接蔓延
B. 血行转移
C. 种植转移
D. 淋巴转移
E. 沿肠管转移

正确答案：D。淋巴转移